下列哪项是现况调查最常见的偏倚
A. 无应答偏倚
B. 幸存者偏倚
C. 失访偏倚
D. 混杂偏倚
E. 测量偏倚

正确答案：A。无应答偏倚

解析：本题考查现况调查最常见的偏倚。现况调查常见的偏倚为：无应答偏倚、幸存者偏倚、报告偏倚、回忆偏倚、调查偏倚、测量偏倚等。其中无应答偏倚（A对BCDE错）是最常见的偏倚。